下列哪个神经不支配面部皮肤一般感觉
A. 下颌神经
B. 上颌神经
C. 眼神经
D. 面神经颅外分支
E. 以上都支配

正确答案：D。面神经颅外分支

解析：面神经颅外分支（D对）主要支配面部表情肌，不支配面部皮肤一般感觉。下颌神经（A错）的感觉纤维支配颞部、耳前、口裂以下的皮肤感觉。上颌神经（B错）穿出眶下孔后的分支支配眼睑及睑裂与口裂之间的皮肤感觉。眼神经（C错）仅含躯体感觉纤维，支配额顶部及上脸和鼻背部的皮肤感觉。